肺的生理功能为
A. 统摄血液
B. 助心行血
C. 运化水谷
D. 调畅气机
E. 主司水液

正确答案：B。助心行血

解析：肺的生理功能为：1.司呼吸主气2.主行水3. 朝百脉，主治节（朝百脉指肺具有辅心行血于周身的生理机能（B对），主治节指肺气具有治理调节肺之呼吸及全身之气、血、津液的机能）。脾的生理功能为：1.主运化（运化包含运化谷食和运化水饮）（C错）2.主统血（A错）。肝的生理功能为：1.主疏泄（指肝气具有疏通、畅达全身气机，进而调畅精血津液的运行输布、脾胃之气的升降、胆汁的分泌排泄以及情志活动等作用）（D错）2.主藏血。肾的生理功能为1.主藏精2.主水（E错）3.主纳气。